40岁患功血，下述哪种变化以手术切除子宫为佳
A. 增殖期子宫内膜
B. 萎缩型子宫内膜
C. 子宫内膜复杂型不典型增生
D. 子宫内膜单纯型不典型增生
E. 子宫内膜剥脱不全

正确答案：C。子宫内膜复杂型不典型增生

解析：C答案属于癌前病变，故以手术切除子宫为佳。掌握“功能失调性子宫出血”知识点。